艾滋病病毒主要侵害人体细胞中的
A. T淋巴细胞
B. 淋巴细胞
C. 抑制性T细胞
D. 辅助性T细胞
E. 巨噬细胞

正确答案：D。辅助性T细胞